患者，男，20岁。因饮食不洁，突发频繁呕吐，腹痛，腹泻，呈水样便，无粘液及脓血，亦无里急后重，体温升高。应首先考虑的是
A. 轻型细菌性痢疾
B. 阿米巴痢疾
C. 霍乱
D. 血吸虫病
E. 急性胃肠炎

正确答案：C。霍乱

解析：霍乱临床上为无痛性泻吐，以剧烈的腹泻继之以呕吐米泔水样物为特征，大便亦呈米泔水样，本例患者出现霍乱的典型泻吐症状：突发频繁呕吐，腹痛，腹泻，呈水样便，无粘液及脓血，亦无里急后重，体温升高，故应首先考虑的诊断为霍乱（C对），粪便培养霍乱弧菌阳性可确诊。轻型细菌性痢疾（A错）全身毒血症状和肠道症状均较轻，可无发热或仅低热，腹痛轻微，里急后重感不明显，大便每日少于10次，为稀便或稀水便，有黏液但无脓血，病程3～7天，少数亦可转为慢性，易被误诊为肠炎。阿米巴痢疾（B错）起病缓慢，全身症状较轻，无发热或仅有低热，主要表现为腹泻，每日3～10次，呈暗红色果酱样，常不伴有里急后重。血吸虫病（D错）由皮肤接触含尾蚴的疫水而感染，主要病变为肝与结肠中由虫卵引起的肉芽肿，急性期有发热、肝肿大与压痛、腹痛、腹泻、便血等，血中嗜酸性粒细胞显著增多；慢性期以肝脾肿大为主；晚期则以门静脉周围纤维化为主，可发展为肝硬化、巨脾与腹水。急性胃肠炎（E错）以恶心、呕吐、腹痛、腹泻等表现为主要特征，胃肠道症状较霍乱轻微。